海氏三角
A. 由腹直肌外侧缘、腹股沟韧带和腹壁浅动脉围成
B. 由腹直肌外侧缘、腹股沟韧带和腹壁下动脉围成
C. 腹腔内容物从海氏三角膨出称为斜疝
D. 由腹直肌内侧缘、腹股沟韧带与腹壁下动脉围成
E. 无

正确答案：B。由腹直肌外侧缘、腹股沟韧带和腹壁下动脉围成

解析：海氏（腹股沟）三角由腹直肌外侧缘、腹股沟韧带和腹壁下动脉围成（B对）。